功能催产的药物是
A. 麝香
B. 冰片
C. 两者均是
D. 两者均不是

正确答案：A。麝香

解析：本题考查的是麝香与冰片的功效。麝香与冰片均无催产功效（D对）。麝香（A错）：【功效】开窍醒神，活血通经，消肿止痛。冰片（B错）：【功效】开窍醒神，清热止痛。催产为红花的功效。红花：【功效】活血通经，祛瘀止痛。红花小剂量活血通经，大剂量破血催产。